合格药品库（区）应标示
A. 红色色标
B. 黄色色标
C. 蓝色色标
D. 绿色色标
E. 紫色色标

正确答案：D。绿色色标

解析：本题考查药品储存的色标管理。在人工作业的库房储存药品，按质量状态实行色标管理，合格药品为绿色（D对），不合格药品为红色，待确定药品为黄色。